以下哪项不属于牙髓坏死的临床表现
A. 有自觉症状
B. 开放髓腔时可有恶臭
C. 牙髓温度测验无反应
D. 牙髓电测验无反应
E. X线片示根尖周无异常

正确答案：A。有自觉症状

解析：牙髓坏死临床表现：无自觉症状，探深龋洞的穿髓孔无反应，开放髓腔时可有恶臭。牙髓诊断性试验（温度测验和电测验）无反应；牙龈无根尖来源的瘘管。X线片示根尖周影像无明显异常。掌握“牙髓坏死、牙髓钙化与牙内吸收”知识点。